惊厥性全身性癫痫持续状态必须从速控制发作，并保持不再复发的时间至少为
A. 6小时
B. 12小时
C. 24小时
D. 48小时
E. 72小时

正确答案：C。24小时

解析：惊厥性全身性癫痫持续状态是内科常见急症，若不及时治疗可因高热、循环衰竭、电解质紊乱或神经元兴奋毒性损伤导致永久性脑损害，致残率和死亡率均很高。因此临床必须从速控制发作，并保持24小时（C对）-48小时内不再发作。